狂犬病的发病原理为
A. 繁殖期、侵入中枢神经区、扩散期
B. 繁殖期、扩散期、侵入中枢神经区
C. 扩散期、侵入中枢神经区、繁殖期
D. 扩散期、繁殖期、侵入中枢神经区
E. 侵入中枢神经区、繁殖期、扩散期

正确答案：A。繁殖期、侵入中枢神经区、扩散期

解析：狂犬病的致病过程可分三个阶段:组织内病毒小量增殖期；侵入中枢神经期；向各器官扩散器（A对）。增殖期病毒先在伤口附近的肌细胞小量增殖，在局部可停留3天或更久，然后入侵人体近处的末梢神经；侵入中枢神经期病毒以较快的速度沿神经的轴突向中枢神经作向心扩展，至脊髓的背根神经节大量繁殖，入侵脊髓并很快到达脑部，主要侵犯脑干、小脑等处的神经细胞；扩散期病毒从中枢神经向周围神经扩散，侵入各器官组织。